口服后在肝脏水解为阿昔洛韦而发挥抗疱疹病毒作用的药物是
A. 昔多福韦
B. 喷昔洛韦
C. 伐昔洛韦
D. 泛昔洛韦
E. 伐更昔洛韦

正确答案：C。伐昔洛韦

解析：本题考查药物的作用机制。核苷类抗疱疹病毒药物伐昔洛韦（C对）为阿昔洛韦的L-缬氨酸酯，属前药，口服后在肝脏水解为阿昔洛韦而发挥抗疱疹病毒作用。昔多福韦（A错）为开环核甘酸类似物，在细胞胸苷激酶作用下转化为单磷酸酯、二磷酸酯和磷酸胆碱的生成物，对CMV的DNA聚合酶产生抑制。喷昔洛韦（B错）为核苷类抗病毒药，体外对Ⅰ型和Ⅱ型单纯疱疹病毒有抑制作用，在病毒感染的细胞中，病毒胸腺嘧啶脱氧核苷激酶将喷昔洛韦磷酸化为喷昔洛韦单磷酸盐，然后细胞激酶将喷昔洛韦单磷酸盐转化为喷昔洛韦三磷酸盐。泛昔洛韦（D错）在体内迅速转化为有抗病毒活性的化合物喷昔洛韦，后者对Ⅰ型单纯疱疹病毒（HSV-1），Ⅱ型单纯疱疹病毒（HSV-2）以及水痘带状单纯疱疹病毒（VZV）有抑制作用。伐更昔洛韦（E错）（VGCV）为更昔洛韦的前药，口服后在肠道和肝脏中水解成为更昔洛韦，发挥相同的抗病毒作用，其口服生物利用度是更昔洛韦的10倍，与更昔洛韦静脉滴注的生物利用度相近。